29岁女性，人工流产术中突感胸闷、头晕、恶心。查体：面色苍白、大汗淋漓，血压70/50mmHg，脉搏50次/分。此时应首先给予
A. 输血补液
B. 阿托品静脉注射
C. 苯巴比妥钠肌注
D. 迅速消除官腔内容物
E. 阿拉明静脉滴注

正确答案：B。阿托品静脉注射

解析：患者人流术中出现胸闷、头晕、面色苍白、大汗淋漓、血压降低、心率缓慢（人工流产综合反应是指手术时疼痛或局部刺激，使受术者在术中或术毕出现恶心呕吐、心动过缓、心律不齐、面色苍白、头昏、胸闷、大汗淋漓，严重者甚至出现血压下降、昏厥、抽搐等迷走神经兴奋症状），应考虑人工流产综合反应，主要是迷走神经兴奋所致，其治疗首选M受体阻滞剂阿托品静脉注射（B对），而不是用阿拉明（也称间羟胺，为拟肾上腺素药物）升压（E错）。输血输液（A错）抗休克、苯巴比妥钠肌注（C错）镇静催眠为一般性治疗。迅速清除宫腔内容物（D错），为术中阴道出血较多时的处理原则。